抗原提呈细胞所不具备的作用是
A. 促进T细胞表达特异性抗原受体
B. 降解抗原为小分子肽段
C. 使MHC分子与抗原肽结合
D. 将抗原肽：MHC复合物提呈给T细胞
E. 为T细胞活化提供第二信号

正确答案：A。促进T细胞表达特异性抗原受体